药品生产企业销售前应当按规定在指定药品检验机构检验的是
A. 麻醉药品
B. 第一类精神药品
C. 第二类精神药品
D. 放射性药品
E. 第一类疫苗

正确答案：E。第一类疫苗

解析：本题考查疫苗生产管理制度。药品生产企业销售前应当按规定在指定药品检验机构检验的是第一类疫苗（E对）。每批疫苗销售前或者进口时，应当经国务院药品监督管理部门指定的批签发机构按照相关技术要求进行审核、检验。